哪项是饮水氟化的不足之处
A. 可引起轻度氟牙症
B. 造成氟的浪费
C. 造成环境中氟的污染
D. 通过立法程序、实施有难度
E. 以上说法均正确

正确答案：E。以上说法均正确

解析：饮水氟化的不足之处：①可引起轻度氟牙症的患病率升高，尽管大多数学者认为这种轻度的氟牙症不影响美观，但仍有人对此表示忧虑：②人群饮用的氟化水的量仅占氟化水总量的2%～3%，这样可能会造成氟的浪费以及环境中氟的污染；③需要通过立法程序，增加了实施的难度。掌握“氟的全身及局部应用”知识点。